一次局部麻醉应用利多卡因的最大剂量是
A. 3.3mg/kg
B. 2.2mg/kg
C. 4.4mg/kg
D. 8.8mg/kg
E. 7.7mg/kg

正确答案：C。4.4mg/kg

解析：本题考查常用的局部麻醉药物的使用。一次局部麻醉应用利多卡因的最大剂量是4.4mg/kg（C对）。